属于胆碱酯酶复活剂的药物是
A. 阿托品
B. 地塞米松
C. 双复磷
D. 西地兰
E. 尼可刹米

正确答案：C。双复磷

解析：胆碱酯酶复活药是一类能使已被有机磷酸酯类抑制的胆碱酯酶恢复活性的药物，其出现使有机磷酸酯类中毒的治疗获得了新的发展，它不但使单用阿托品所不能控制的严重中毒病例得到解救，而且显著地缩短了一般中毒的病程。常用的有碘解磷定和氯磷定（C对）；阿托品为抗胆碱药，用于各种内脏绞痛，如胃肠绞痛及膀胱刺激症状（A错）；地塞米松是一种肾上腺皮质激素药，主要用于抗炎、抗过敏、免疫抑制、抗中毒和抗休克等（B错）；西地兰是快速强心药，用于急性和慢性心力衰竭、心房颤动和阵发性室上性心动过速（D错）；尼可刹米是中枢神经系统兴奋药，主要用于兴奋延髓呼吸中枢，用于中枢性呼吸功能不全、各种继发性呼吸抑制、慢性阻塞性肺疾病伴高碳酸血症。也用于解救中枢性呼吸抑制及循环衰竭、吗啡中毒、严重传染病所致的呼吸衰竭，或用于吸入麻醉药中毒（E错）。